粉末嗅之作嚏，断面沾水，即呈乳白色隆起的药材是
A. 鸡内金
B. 蛤蚧
C. 地龙
D. 水蛭
E. 蟾酥

正确答案：E。蟾酥

解析：本题考查的是蟾酥的性状鉴别。粉末嗅之作嚏，断面沾水，即呈乳白色隆起的药材是蟾酥（E对）。蟾酥【性状鉴别】药材呈扁圆形团块状或片状。棕褐色或红棕色。团块状者质坚，不易折断，断面棕褐色，角质状，微有光泽；片状者质脆，易碎，断面红棕色，半透明。气微腥，味初甜而后有持久的麻辣感，粉末嗅之作嚏。以色红棕、断面角质状、半透明、有光泽者为佳。饮片蟾酥粉：为棕黄色至棕褐色粉末。气微腥，味初甜而后有持久的麻辣感，嗅之作嚏。鸡内金（A错）【性状鉴别】饮片炒鸡内金：表面暗黄褐色至焦黄色，用放大镜观察，显颗粒状或微细泡状。轻折即断，断面有光泽。蛤蚧（B错）【性状鉴别】饮片蛤蚧：呈不规则的片状小块，表面灰黑色或银灰色，有棕黄色斑点及鳞甲脱落后的痕迹。切面黄白色或灰白色。脊椎骨和肋骨突起清晰。气腥，味微咸。地龙（C错）【性状鉴别】药材广地龙：呈长条状薄片，弯曲，边缘略卷，体具环节，背部棕褐色至紫灰色，腹部浅黄棕色。体轻，略呈革质，不易折断。气腥，味微咸。水蛭（D错）【性状鉴别】饮片水蛭：呈不规则的段状、扁块状或扁圆柱状。背部表面黑褐色，稍隆起，腹面棕褐色，均可见细密横环纹。切面灰白色至棕黄色，胶质状。质脆，气微腥。